能有目标地扔皮球的月龄
A. 7月
B. 9月
C. 12月
D. 15月
E. 18月

正确答案：E。18月

解析：2个月开始抬头；4个月手能握持玩具；5个月扶腋下能站得直，两手各握一玩具；6个月能独坐一会儿，用手摇玩具；7个月会翻身，独坐很久，将玩具换手；8个月会爬，会拍手及扶栏杆站起；9个月试独站；10～11个月推车走几步，用拇、示指对指拿东西，可独站片刻；1周岁左右逐渐会走，弯腰取东西，会将圆圈套在木棍上；1.5岁后会蹲着玩，爬台阶，有目标地扔皮球；2岁左右会双脚跳，会用勺子吃饭；3岁会跑，骑三轮车等。掌握“运动和语言发育”知识点。